物理化学配伍禁忌的处理方法，不包括
A. 改变贮存条件
B. 改变调配次序
C. 改变溶剂或添加助溶剂
D. 调整溶液的pH值
E. 测定药物动力学参数

正确答案：E。测定药物动力学参数

解析：本题考查药物的配伍变化。物理化学配伍禁忌的处理方法，不包括测定药物动力学参数（E错，为本题正确答案）。测定动力学是研究药物体内药量随时间变化规律的科学，不属于物理化学配伍禁忌的处理方法。物理化学配伍禁忌的处理方法包括：改变贮存条件（A对）、改变调配次序（B对）、改变溶剂或添加助溶剂（C对）、调整溶液pH（D对）、改变有效成分或改变剂型等。